应用政治军事压力从事违背伦理原则的实验称为
A. 临床试验
B. 强迫实验
C. 天然实验
D. 自体实验
E. 志愿实验

正确答案：B。强迫实验

解析：强迫试验是非人道的试验，通常是在武力或政治的压力下，违背受试者本人意愿而进行的试验（B对）。临床试验与直接直接治疗疾病有关（A错）。天然试验是不对试验对象进行任何干涉，不受研究者控制的在天然条件下（如战争、早旱灾、水灾、地震、瘟疫及疾病高发区等）的人体试验，具有肯定的道德价值（C错）。志愿试验是受试者在一定社会和经济目的的支配下自愿参加的试验（E错）。